多次重复给药，基本达到稳态血药浓度所需的半衰期大约是
A. 1个
B. 3个
C. 5个
D. 7个
E. 9个

正确答案：C。5个

解析：按一级动力学消除的药物经过一个t1/2后，消除50%，经过两个t1/2后，消除75%，经过5个t1/2，体内药物消除约97%，也就是说约5个t1/2，药物基本从体内消除，反之若按固定剂量、固定时间给药，或恒速静脉滴注，经4～5个t1/2基本达到稳定血药浓度（C对）。